以下不是《全球非传染性疾病预防与控制行动计划2013-2020》的重要原则的选项是
A. 慢性病防治应尽早，从青年开始是最佳时机
B. 慢性病防控策略和实践应遵循循证的方法
C. 实现健康广覆盖
D. 保护公共政策、防控策略等不会受到任何形式既定利益的不恰当的影响
E. 关注健康的社会决定因素，减少健康不平等

正确答案：A。慢性病防治应尽早，从青年开始是最佳时机

解析：本题考查《全球非传染性疾病预防与控制行动计划2013-2020》的重要原则。《全球非传染性疾病预防与控制行动计划2013-2020》的重要原则包括：①采取生命全程策略，从育龄妇女健康开始，受孕前、产前、婴幼儿、儿童青少年、成年和老年，每个阶段都有预防和控制慢性病的机会。其中，生命早期的干预是第一级预防的最佳时机（A错，为本题正确答案）。②动员全社会参与到慢性病的防控行动中来。③慢性病防控策略和实践应该基于当前最好的科学证据和（或）最佳实践、现有资源、社会的需要和价值取向，即循证的方法（B对）。④实现健康广覆盖（C对），即所有人都能平等地获得基本公共卫生服务以及基本的、安全、可负担、有效的药品，特别强调贫困人群、社会弱势群体不会因为使用这些服务而有很大的经济压力。⑤在全社会参与到慢性病防控实践的过程中，必须保护公共卫生政策、防控策略和多部门行动不会受到任何形式的既定利益的不恰当的影响（D对），如烟草防控。⑥达到可实现的健康的最高标准是每个人享有的最基本的权利，不会因性别、国家、民族、语言、宗教信仰、社会经济状况等不同。⑦应该认识到，慢性病表现出来的不平等的分布根本上是因为健康的社会决定因素的分布不平等（E对）。针对这些决定因素采取的行动，对于全人群或弱势群体来说就是创造包容、公平、生产力高和健康的社会。⑧应该充分认识到政府在慢性病防控中的主导作用和责任，同时发挥国际协作的重要作用。⑨有效的慢性病防控需要多部门行动。各部门在决策过程中应该充分考虑不同决策对健康及其决定因素的影响，保证决策对人群健康是无害或有益的。